可与碱形成水溶性盐，用于口服或静脉注射给药的药物是
A. 青蒿素
B. 二氢青蒿素
C. 青蒿琥酯
D. 蒿甲醚
E. 蒿乙醚

正确答案：C。青蒿琥酯

解析：本题考查青蒿素类药物。青蒿琥酯（C对）是用琥珀酸对二氢青蒿素进行酯化得到的水溶性药物，可口服或静脉注射给药。